下列剂型给药可以避免“首过效应”的有
A. 注射剂
B. 气雾剂
C. 口服溶液
D. 舌下片
E. 肠溶片

正确答案：A、B、D。注射剂；气雾剂；舌下片

解析：本题考查首过效应。为避免首过效应，常采用注射剂（A对）、舌下片（D对）、鼻腔、肺部（B对）、直肠下部给药或经皮方式给药。药物吸收过程不经过肝脏，直接进入体循环，从而减少首过效应的损失；肠溶片（E错）与口服溶液（C错）均属于口服给药制剂，易产生较大的首过效应。